可用于缓解绝经后更年期症状的药品是
A. 戊酸雌二醇
B. 他莫昔芬片
C. 地屈孕酮
D. 依普黄酮
E. 司坦唑醇

正确答案：A。戊酸雌二醇

解析：本题考查戊酸雌二醇。戊酸雌二醇（A对）口服用于缓解绝经后更年期症状、卵巢切除后及非癌症疾病放疗性去势的雌激素缺乏引起的症状。地屈孕酮（C错）用于习惯性流产。司坦唑醇（E错）临床适用于防治遗传性血管神经性水肿、慢性消耗性疾病、重病及术后体弱消瘦、年老体弱、骨质疏松症、儿童发育不良、再生障碍性贫血、白细胞减少症、血小板减少症、高脂血症等。